正确描述股神经的是
A. 发自骶丛
B. 在股三角内位于股动脉内侧
C. 有分支支配股四头肌
D. 有分支支配股二头肌
E. 在股三角内、行于股动、静脉之间

正确答案：C。有分支支配股四头肌

解析：股神经发自腰丛（A错），于股动脉的外侧进入大腿的股三角区（B错），其中肌支主要分布于髂肌、耻骨肌、股四头肌（C对）和缝匠肌。